双颞侧视野偏盲，损伤的部位在
A. 视觉中枢
B. 视交叉内交叉纤维
C. 内侧膝状体
D. 视交叉左侧不交叉纤维
E. 视交叉右侧不交叉纤维

正确答案：B。视交叉内交叉纤维

解析：当视觉传导通路的不同部位受损时，可引起不同的视野缺损： 视网膜损伤引起的视野缺损与损伤的位置和范围有关； 一侧视神经损伤可致该侧眼视野全盲； 视交叉中交叉纤维（B对）损伤可致双眼视野颞侧半偏盲；一侧视束及以后的视觉传导路（视辐射、视区皮质）受损，可致双眼病灶对侧半视野同向性偏盲（如右侧受损则右眼视野鼻侧半和左眼视野颞侧半偏盲）。